参照人体尺寸进行设计的工具、机器设备，一般要求适合于
A. 90%的人
B. 从低到高90%的人群
C. 95%的人
D. 85%的人
E. 99%的人

正确答案：A。90%的人